按病因分类将肺炎分为
A. 非典型病原体所致肺炎
B. 细菌性肺炎
C. 病毒性肺炎
D. 真菌除肺炎
E. 以上均是

正确答案：E。以上均是

解析：按病因分类将肺炎分为：①细菌性肺炎；②非典型病原体所致肺炎；③病毒性肺炎；④真菌性肺炎；⑤其他病原体所致肺炎。掌握“肺炎”知识点。